蒙药的传统剂型有
A. 汤剂
B. 散剂
C. 丸剂
D. 灰剂
E. 搅全剂

正确答案：A、B、C、D、E。汤剂；散剂；丸剂；灰剂；搅全剂

解析：本题考查的是蒙药的传统剂型。蒙药的传统剂型有汤剂（A对）、散剂（B对）、丸剂（C对）、灰剂（D对）与搅全剂（E对）。蒙药的传统剂型有8种。1.汤剂（汤散）；2.散剂；3.丸剂；4.膏剂；5.灰剂；6.油剂。此外还有搅全剂与酒剂，现已不常用。